某工人在夏季施用有机磷农药时，出现恶心、呕吐、腹痛、腹泻、视力模糊等症状，对其进行治疗处理时，首选治疗措施是
A. 使用阿托品
B. 使用解磷定
C. 吸氧
D. 人工呼吸
E. 输液

正确答案：A。使用阿托品

解析：本题考查有机磷酸酯农药中毒治疗。结合工人的症状和“图3-9 急性有机磷中毒的主要症状和体征”一图可判断工人为有机磷农药轻度中毒。应迅速给予解毒药物，轻度中毒者可单独给予阿托品（A对BCDE错）。注意阿托品化（瞳孔扩大、颜面潮红、皮肤无汗、口干、心率加速），防止阿托品过量、中毒。